方圆形弓形牙列从哪颗牙开始弯曲向后
A. 切牙的远中
B. 尖牙的远中
C. 前磨牙的远中
D. 第一磨牙的远中
E. 第二磨牙的远中

正确答案：B。尖牙的远中

解析：方圆形：上、下牙列中四个切牙的切缘唇侧连线略直，弓形牙列从尖牙的远中才开始弯曲向后。掌握“牙列”知识点。